女，35岁。发热10天，体温37.9℃，周身不适，乏力。2天后体温恢复正常，但乏力加重，尿色变黄，伴食欲不振，腹胀。既往无肝炎病史。实验室检查：ALT1008U/L，TBiL87μmol/L，HBsAg（+），HBeAg（+），抗HBcIgm（＋）。抗HAVIgG（+），HAVIgM（-）。最可能的诊断是
A. 病毒性肝炎，甲乙型病毒混合感染，急性黄疽型
B. 病毒性肝炎，乙型，急性黄疸型，HAV既往感染
C. 病毒性肝炎，乙型，急性黄疸型，HAV携带者
D. 病毒性肝炎，甲型，急性黄疸型，HBV携带者
E. 病毒性肝炎，甲型，急性黄疸型，HBV既往感染

正确答案：B。病毒性肝炎，乙型，急性黄疸型，HAV既往感染

解析：患者HBsAg（+），HBeAg（+），抗HBcIgm（＋）。为乙肝病毒感染“大三阳”表现，提示HBV 现症感染，且HBV 复制活跃，有传染性；ALT1008U/L（谷丙转氨酶，正常值：5-40 U/L（单位/升）），TBiL87μmol/L（正常值1.71-17.1μmol/L），二者大幅度升高提示肝功能损害（ADE错）。（4 版实用传染病学P524）抗HAV IgM 阳性是早期诊断甲型肝炎的特异性指标。抗HAV IgG 阳性出现于病程恢复期，表示既往感染，较持久，甚至终生阳性，是获得免疫力的标志，不是诊断指标，仅用于流行病学调查（C错B对）。